Felty综合征引起的中性粒细胞减少的最可能机制是
A. 生成减少
B. 成熟障碍
C. 免疫性破坏过多
D. 非免疫性破坏过多
E. 分布异常

正确答案：C。免疫性破坏过多

解析：Felty综合征是指RA患者伴有脾大、中性粒细胞减少，有的甚至有贫血和血小板减少（P809）。Felty综合征为类风湿关节炎的特殊类型，为自身免疫性疾病，因此其最可能的机制为免疫性破坏过多（C对）。生成减少（A错）多见于再生障碍性贫血。成熟障碍（B错）多见于巨幼细胞性贫血或骨髓增生异常综合征等引起的无效造血。非免疫性破坏过多（D错）多见于脾大引起的脾功能亢进。分布异常（E错）多见于异体蛋白反应、内毒素血症等。